控制交通噪声可采取的措施有
A. 完善城市道路系统、规划措施
B. 建筑措施
C. 管理措施
D. A＋B＋C
E. A＋C

正确答案：D。A＋B＋C

解析：本题考查控制交通噪声可采取的措施。控制交通噪声可采取的措施有：完善城市道路系统、规划措施、管理措施（D对ABCE错）。